高血压伴前列腺增生患者适宜选用的药物是
A. 硝苯地平
B. 卡托普利
C. 氢氯噻嗪
D. 普萘洛尔
E. 特拉唑嗪

正确答案：E。特拉唑嗪

解析：本题考查降压药。高血压伴前列腺增生患者适宜选用的药物是特拉唑嗪（E对）。特拉唑嗪为α₁受体阻断药，可阻断膀胱颈、前列腺包膜和腺体、尿道等处α₁受体，改善前列腺肥大患者排尿困难症状，适宜用于高血压合并前列腺肥大者。硝苯地平（A错）属于二氢吡啶类钙通道阻滞剂，适用于老年高血压，单纯收缩期高血压，伴稳定型心绞痛、冠状动脉或颈动脉粥样硬化及周围血管疾病患者。卡托普利（B错）属于ACEI类药物，适用于伴慢性心力衰竭、心肌梗死后心功能不全、心房颤动、糖尿病肾病、慢性肾脏病、代谢综合征、蛋白尿或微量白蛋白尿的患者。氢氯噻嗪（C错）为噻嗪类利尿药，适用千老年高血压、单纯收缩期高血压或伴心力衰竭患者，也是难治性高血压的基础控压药物之一。普萘洛尔（D错）属于β受体阻断剂，其适用于交感神经活性增高以及高动力状态的高血压患者，如伴有快速型心律失常、冠心病、慢性心力衰竭的患者。